女，67岁.间断咳嗽、咳痰15年，心悸、气短伴双下肢水肿3天。心电图示胸前导联重度顺钟向转位，V₁导联呈RS型，V₅R/S＜1，RV₁+SV₅=1.5mV。该患者最可能的诊断是
A. 心包积液
B. 扩张型心肌病
C. 风湿性心脏瓣膜病
D. 慢性肺源性心脏病
E. 冠心病，心肌梗死

正确答案：D。慢性肺源性心脏病

解析：老年女性，间断咳嗽、咳痰15年（提示COPD），心悸、气短伴双下肢水肿3天（右心衰体征）。心电图示胸前导联重度顺钟向转位，V₁导联呈RS型，V₅R/S＜1，RV₁+SV₅=1.5mV，提示有肺动脉压增高、右心室增大征象，根据患者病史、体征及心电图，考虑诊断为慢性肺源性心脏病（D对）。心包积液（A错）是由心包疾患或其他病因累计心包造成心包渗出，积液达到一定量时造成心包压塞，最突出的症状是呼吸困难和心音低而遥远。扩张型心肌病（B错）无咳嗽、咳痰，主要表现为活动耐量下降和呼吸困难，随病情进展出现心力衰竭。风湿性心脏瓣膜病（C错）指风湿炎症导致的瓣膜损害，二尖瓣最常受累，其次为主动脉瓣；二尖瓣狭窄表现为呼吸困难、咳嗽、咯血等表现，但心脏杂音为舒张期隆隆样杂音；二尖瓣关闭不全轻度可终生无症状，重度可表现为疲乏无力，活动耐力下降；主动脉瓣狭窄的常见三联征为心绞痛、晕厥和心力衰竭；主动脉瓣关闭不全后期表现为心悸、心前区不适、头颈部强烈搏动感等，心脏杂音为主动脉瓣区舒张期叹气样杂音。冠心病，心肌梗死（E错）指冠状动脉不稳定斑块破裂、糜烂基础上继发血栓形成导致冠脉血管持续、完全闭塞，导致心肌严重而持久地急性缺血，心前区剧烈疼痛为主要表现。